呈类球形或扁球形，直径1.5～3cm；表面乌黑色或棕黑色，皱缩不平；果核坚硬，椭圆形，棕黄色，表面有凹点；气微，味极酸的药材是
A. 山楂
B. 乌梅
C. 木瓜
D. 五味子
E. 山茱萸

正确答案：B。乌梅

解析：本题考查的是乌梅的性状鉴别。呈类球形或扁球形，直径1.5～3cm；表面乌黑色或棕黑色，皱缩不平；果核坚硬，椭圆形，棕黄色，表面有凹点；气微，味极酸的药材是乌梅（B对）。乌梅：【性状鉴别】药材呈类球形或扁球形，直径1.5～3cm。表面乌黑色或棕黑色，皱缩不平，基部有圆形果梗痕。果核坚硬，椭圆形，棕黄色，表面有凹点；种子扁卵形，淡黄色。气微，味极酸。山楂（A错）：【性状鉴别】药材为圆形片，皱缩不平。外皮红色，具皱纹，有灰白小斑点。果肉深黄色至浅棕色。中部横切片具5粒浅黄色果核，但核多脱落而中空。有的片上可见短而细的果梗或花萼残迹。气微清香，味酸、微甜。木瓜（C错）：【性状鉴别】药材长圆形，多纵剖成两半。外表面紫红色或红棕色，有不规则的深皱纹；剖面边缘向内卷曲，果肉红棕色，中心部分凹陷，棕黄色；种子扁长三角形，多脱落。质坚硬，气微清香，味酸。五味子（D错）：【性状鉴别】药材呈不规则的球形或扁球形。表面红色、紫红色或暗红色，皱缩，显油润；有的表面呈黑红色或出现“白霜”。果肉柔软，种子肾形，表面棕黄色，有光泽，种皮薄而脆。果肉气微，味酸；种子破碎后，有香气，味辛、微苦。山茱萸（E错）：【性状鉴别】药材呈不规则的片状或囊状。表面紫红色至紫黑色，皱缩，有光泽。顶端有的有圆形宿萼痕，基部有果梗痕。质柔软。气微，味酸、涩、微苦。